开放
A. 肺主动瓣
B. 二尖瓣
C. 冠状窦口
D. 主动脉瓣
E. 三尖瓣

正确答案：D。主动脉瓣

解析：当心室收缩时主动脉瓣（D对）开放。血液可通过主动脉瓣进入，并可在窦内形成血液小涡流。